感染病原体后，仅引起机体发生特异性免疫应答而临床上不出现特异性的症状与体征称为
A. 病原携带状态
B. 病原体被清除
C. 显性感染
D. 隐性感染
E. 潜伏性感染

正确答案：D。隐性感染

解析：病原体感染人体后，仅引起机体发生特异性免疫应答而临床上不出现特异性的症状与体征称为隐性感染（D对）。病原携带状态（人卫八版传染病学P3）（A错）为病原体感染人体后，停留在入侵部位或在入侵较远脏器继续生长、繁殖，而人体不出现任何的疾病状态，但能携带并排出病原体，成为传染源。病原体被清除（B错）为病原体感染人体后，病原体被机体的非特异性免疫作用和特异性免疫作用所清除。显性感染（人卫八版传染病学P3）（C错）为病原体感染人体后，不仅引起机体发生特异性免疫应答，而且引起组织损伤，临床上出现特异性的症状与体征。潜伏性感染（人卫八版传染病学P3）（E错）为病原体感染人体后，寄生于某些部位，机体免疫功能足以将病原体局限化而不引起显性感染，但不足以清除病原体，当机体免疫功能下降时，可引起显性感染。